男，2岁，发热伴咳嗽，诊断为链球菌肺炎，用抗生素治疗的疗程应持续至体温正常后
A. 2～4天
B. 5～7天
C. 8～10天
D. 11～13天
E. 14～16天

正确答案：B。5～7天

解析：小儿细菌感染性支气管肺炎以链球菌肺炎多见，应用抗生素应持续至体温正常后3~5天，原答案选B。